女，32岁。购物时感头晕，恶心，乏力，随即意识消失，摔倒在地，约1分钟自行苏醒，无大小便失禁，无遗留意识或肢体功能障碍。其意识丧失最可能的病因为
A. 分离（转换）性障碍
B. 低血糖症
C. 迷走神经张力异常增高
D. 短暂性脑缺血发作
E. 心率失常

正确答案：C。迷走神经张力异常增高

解析：女性32岁患者，突发头晕，恶心，乏力，随即意识消失约1分钟自行苏醒，无大小便失禁，无遗留意识或肢体功能障碍。根据临床表现，血管抑制性晕厥可能性最高，其机制是由于迷走神经张力异常增高（C对），分离（转换）性障碍、低血糖症、心率失常和患者临床症状不相符（ABE错），短暂性脑缺血发作多好发与中老年人，男性多于女性，多伴有高血压动脉硬化糖尿病等脑血管病危险因素，临床表现多于受累血管有关。本题从发病原因和临床表现考虑，血管抑制性晕厥可能性更高，所以短暂性脑缺血发作不是正确答案（D错）。